下列哪一种情况下氧解离曲线发生右移
A. 肺通气阻力减小
B. 代谢性碱中毒
C. 2，3-二磷酸甘油酸增多
D. 血温降低
E. 血CO₂分压下降

正确答案：C。2，3-二磷酸甘油酸增多